中药材生产应符合《中药材生产质量管理规范》，下列关于中药材生产质量管理规范说法错误的是
A. 企业应当根据中药材生产特点，明确影响中药材质量的关键环节，开展质量风险评估制定有效的生产管理与质量控制、预防措施
B. 质量管理负责人应当有中药学、中医学或者农学等相关专业本科及以上学历并有中药材生产、质量管理3年以上实践经验
C. 中药材生产基地一般应当选址于道地产区，在非道地产区选址，应当提供充分文献或者科学数据证明其适宜性
D. 企业应当定期组织对中药材生产质量管理规范实施情况的内审，确认是否符合要求

正确答案：B。质量管理负责人应当有中药学、中医学或者农学等相关专业本科及以上学历并有中药材生产、质量管理3年以上实践经验

解析：本题考查中药材生产质量管理。《中药材生产质量管理规范》主要内容包括：①质量管理。企业应当根据中药材生产特点，明确影响中药材质量的关键环节，开展质量风险评估，制定有效的生产管理与质量控制、预防措施（A对）。②机构与人员。企业负责人对中药材质量负责；企业应当配备足够数量并具有和岗位职责相对应资质的生产和质量管理人员；生产、质量的管理负责人应当有中药学、药学或者农学等相关专业大专及以上学历并有中药材生产、质量管理三年以上实践经验（B错，为本题正确答案），或者有中药材生产、质量管理五年以上的实践经验，且均须经过《中药材生产质量管理规范》的培训。④基地选址。中药材生产基地一般应当选址于道地产区，在非道地产区选址，应当提供充分文献或者科学数据证明其适宜性（C对）。企业应当定期组织对本规范实施情况的内审（D对），对影响中药材质量的关键数据定期进行趋势分析和风险评估，确认是否符合本规范要求，采取必要改进措施。